已婚妇女，32岁。1年前曾人工流产并行绝育术，近3月阴道不规则流血，妇科检查：子宫稍大双附件区未查异常，尿HCG（+），胸片见右肺有1cm直径的两个阴影，边缘模糊。可能的诊断是
A. 异位妊娠
B. 不全流产
C. 月经失调
D. 侵蚀性葡萄胎
E. 绒毛膜癌

正确答案：E。绒毛膜癌

解析：患者为年轻妇女，1年前曾人工流产（非葡萄胎妊娠后只继发绒癌），近3月阴道不规则流血（滋养细胞肿瘤表现为在葡萄胎排空、流产或足月产后，有持续的不规则阴道流血，量多少不定），妇检：子宫稍大（子宫复旧不全或不均匀性增大），双附件区未查异常，尿hCG（﹢）（足月产、流产和异位妊娠后hCG多在4周左右转为阴性），胸片见右肺有1cm直径的两个阴影，边缘模糊（肺转移的最初X线征象为肺纹理增粗，以后发展为片状或小结节阴影，典型表现为棉球状或团块状阴影。转移灶以右侧肺及中下部较为多见），应考虑为绒毛膜癌（E对）。侵蚀性葡萄胎（D错）全部继发于葡萄胎妊娠。异位妊娠（P53）（A错）早期常无特殊的临床表现，与早孕或先兆流产相似，晚期发生破裂时，突感一侧下腹部撕裂样疼痛，伴恶心呕吐，常有不规则阴道流血，妇检子宫大小与停经月份相符；不全流产（P48）（B错）指难免流产继续发展，部分妊娠物排出宫腔，还有部分残留，影响子宫收缩，致大量出血，妇检见子宫小于停经周数；月经失调（C错）是由多种病因引起的月经规律的改变，三者均无肺转移征象。